MHC-Ⅰ类分子的功能
A. 为CD8⁺杀伤性T细胞的识别分子
B. 参与外源性抗原提呈
C. 参与内源性抗原提呈
D. A+B选项
E. A+C选项

正确答案：E。A+C选项

解析：本题考查MHC-Ⅰ类分子的功能。MHC-Ⅰ类分子的功能为识别和提呈内源性抗原肽（C对），参与内源性抗原提呈；为CD8⁺杀伤性T细胞的识别分子（A对），可与辅助受体CD8结合，对CTL的识别起限制作用。（AC均对，故E为本题的正确答案）。参与外源性抗原提呈（B错）的是MHC-Ⅱ类分子的功能.